患者，男，40岁。患神经性头痛已5年，每月发作3～5次，每次持续1～2天，每次发作时头胀痛欲裂，耳鸣，目赤，口苦，烦躁易怒，尿赤便干，舌边红苔黄，其脉象的表现是
A. 弦数
B. 弦紧
C. 浮数
D. 弦涩
E. 细弦

正确答案：A。弦数

解析：题干中患者头胀痛欲裂，耳鸣，目赤，口苦，皆为肝阳上亢、肝胆实火之症，故其脉象应为弦数之象（A对）。弦紧脉多见于寒证、痛证，常见于寒滞肝脉，或肝郁气滞所致疼痛等（B错）。浮数脉多见于风热袭表的表热证（C错）。弦细脉多见于肝肾阴虚或血虚肝郁，或肝郁脾虚等证（E错）。